手三阳经的走向为
A. 从头走足
B. 从足走腹
C. 从胸走手
D. 从手走头
E. 从手走足

正确答案：D。从手走头

解析：该题考查十二经脉的循行走向规律。十二经脉的循行走向总的规律是：手三阴经从胸走手（C错），手三阳经从手走头（D对），足三阳经从头走足（A错），足三阴经从足走胸腹（B错）。从手走足为干扰选项（E错）。记忆：可结合中基（P160）图4-1的十二经脉走向交接规律示意图记忆。